患者有风湿性关节炎病史。查体：心尖部可闻及4级全收缩期吹风样杂音，常向左腋下、左肩胛下部传导，X线显示左心房、左心室增大。应首先考虑的心瓣膜病变是
A. 二尖瓣狭窄
B. 主动脉瓣狭窄
C. 肺动脉瓣狭窄
D. 二尖瓣关闭不全
E. 主动脉瓣关闭不全

正确答案：D。二尖瓣关闭不全

解析：患者有风湿性关节炎病史。检查发现心尖部可闻及4级全收缩期吹风样杂音（心尖区可闻及Ⅲ级以上粗糙全收缩期杂），常向左腋下、左肩胛下部传导，X线显示左心房、左心室增大，首先考虑二尖瓣关闭不全（D对）。二尖瓣狭窄（A错）心尖区有舒张期隆隆样杂音伴左心房增大。主动脉瓣狭窄（B错）的特点为主动脉瓣区喷射性收缩期杂音，向颈部传导。肺动脉瓣狭窄（C错）常引起右心室增大。主动脉瓣关闭不全（E错）的特点为主动脉瓣第二听诊区舒张早期递减型吹风样杂音，伴左心室增大，和周围血管征。